下列哪个是耐盐细菌
A. 痢疾志贺菌
B. 破伤风梭菌
C. 副溶血性弧菌
D. 白喉棒状杆菌
E. 结核分枝杆菌

正确答案：C。副溶血性弧菌